白芥子灸属
A. 艾条灸
B. 艾炷灸
C. 温和灸
D. 温针灸
E. 天灸

正确答案：E。天灸

解析：常用灸法分为艾灸法和非艾灸法：1.艾灸法分为艾柱灸、艾条灸、温针灸和温灸器灸，其中艾条灸又分为悬起灸（包括：温和灸、雀啄灸、回旋灸）和实按灸（包括：太乙神针、雷火神针），艾柱灸分为直接灸（包括：瘢痕灸，非瘢痕灸）和间接灸第十版针灸学（包括隔姜灸、隔蒜灸、隔盐灸、隔附子饼灸等）；2.非艾灸法分为灯火灸和天灸（包括：白芥子灸（E对）、细辛灸、大蒜灸、斑螯灸等）。